等标污染负荷是评价各污染源和污染物的相对危害程度，其计算式为Pi＝mi/Ci，其中Ci代表
A. i污染物的排放实测浓度
B. i污染物的排放量
C. i污染物排放浓度的监测次数
D. i污染物的评价标准
E. i污染物浓度的排放标准

正确答案：E。i污染物浓度的排放标准

解析：本题考查等标污染负荷。等标污染负荷是把i污染物的排放量稀释到其相应排放标准时所需的介质量，用以评价各污染源和各污染物的相对危害程度。其计算式为：Pi＝mi/Ci，式中：Pi为i污染物的等标污染负荷；mi为i污染物的排放量，kg/d；Ci为i污染物的浓度排放标准（E对ABCD错），mg/L或mg/m³。